慢性阻塞性肺疾病最主要的病理生理特征是
A. 气道结构重塑
B. 肺泡通气量下降
C. 持续性气流受限
D. 肺泡弹性回缩力减退
E. 明显的肺外效应

正确答案：C。持续性气流受限

解析：慢阻肺的特征性病理变化是持续气流受限（C对）致肺通气功能障碍，属于阻塞性通气功能障碍肺疾病。气道结构重构（A错）是支气管哮喘的病理生理特征。COPD患者肺泡通气量下降（B错）是由于持续气流受限，肺泡持续扩大，肺泡弹性回缩力减退（D错），回缩障碍，残气量增加所致，不是COPD最主要的病理生理特征。COPD患者可有肺外效应（E错），如晚期患者有体重下降，食欲减退等，是由持续气流受限，机体长期缺氧所致，不是主要的病理生理特征。